铅主要蓄积在
A. 肾脏
B. 肝脏
C. 肺脏
D. 脾脏
E. 骨骼

正确答案：E。骨骼

解析：本题考查铅的蓄积部位。铅可蓄积在体内，人体内90%～95%的铅以不溶性磷酸铅形式储存于骨（E对ABCD错）内，骨铅与血液和软组织中的铅保持着动态平衡。除骨组织外，脑、肝脏、肾脏、肌肉等器官中也有较多的铅分布。